引起急性尿潴留的病因中，属于动力性梗阻的是
A. 膀胱结石
B. 膀胱肿瘤
C. 尿道狭窄
D. 外伤性脊髓损伤
E. 良性前列腺增生

正确答案：D。外伤性脊髓损伤

解析：尿潴留的病因可分为机械性梗阻和动力性梗阻。动力性梗阻包括外伤性脊髓损伤（D对）、马尾损伤、直肠肛管手术后、腰麻术后以及使用松弛平滑肌的药物如阿托品、山莨菪碱等。良性前列腺增生（E错）、前列腺肿瘤、膀胱颈挛缩、各种原因引起的尿道狭窄（C错）、膀胱肿瘤（B错）和尿道结石（A错）等均为其中机械性梗阻因素，较动力性梗阻常见。